男21岁。足底被生锈铁钉刺伤8天，四肢抽搐2天。发作时颈部强直，牙关紧闭，口唇青紫。下列关于该致病菌特点的描述不正确的是
A. 潜伏期一般为7-8天，可短至24h或长达数月、数年
B. 此菌对环境适应性很强，能耐煮沸
C. 为专性厌氧菌，革兰氏染色阳性
D. 产生大量外毒素
E. 破伤风的侵袭力很强

正确答案：E。破伤风的侵袭力很强

解析：青年患者，足底被生锈铁钉刺伤，四肢抽搐。发作时颈部强直，牙关紧闭，口唇青紫（破伤风感染的典型体征），根据患者的临床症状及体征，考虑诊断为破伤风感染，其潜伏期一般为7-8天，可短至24小时或长达数月、数年（A对），病菌是破伤风梭菌，为专性厌氧，革兰染色阳性（C对），此菌对环境适应性很强，能耐煮沸（B对），可产生大量外毒素（D对），其侵袭力并不强（E错，为本题正确答案）。